错误的是
A. 介于睾丸上端与腹股沟管深环之间
B. 又称皮下部
C. 可经皮肤以手触知
D. 为输精管结扎的良好部位
E. 无

正确答案：A。介于睾丸上端与腹股沟管深环之间

解析：介于睾丸上端与腹股沟管深环之间（A错，为本题正确答案）为精索。介于睾丸上端与腹股沟管皮下环之间为输精管精索部。